细菌性阴道病的首选治疗药物是
A. 制霉菌素
B. 甲硝唑
C. 头孢菌素
D. 青霉素
E. 阿奇霉素

正确答案：B。甲硝唑

解析：细菌性阴道病的首选治疗药物是甲硝唑（B对），抑制厌氧菌生长的同时，也不影响乳杆菌生长。